静止龋产生的条件为
A. 机体抵抗力增加
B. 局部致龋因素消失
C. 唾液分泌增加
D. 牙面再矿化能力增加
E. 服用抗生素

正确答案：B。局部致龋因素消失

解析：静止龋是在龋病的进展过程中，由于局部环境发生变化，隐蔽部位变为开放状态，致龋因素消失，病变停止进展并再矿化，但已造成的牙体实际性缺损仍保持原状。掌握“龋病的临床表现与分类”知识点。